新斯的明可引起
A. 眼内压下降
B. 休克
C. 重症肌无力患者肌张力增加
D. 流涎、震颤和肌肉强直症状缓解
E. 肌肉松弛

正确答案：C。重症肌无力患者肌张力增加